嫩红。治疗应首选
A. 百合固金汤
B. 养阴清肺汤
C. 养胃增液汤
D. 麦味地黄丸
E. 知柏地黄丸

正确答案：B。养阴清肺汤

解析：患儿口腔内反复见白屑样物，拭之不去，形体瘦弱，面白颧红，舌质嫩红是白喉证的表现，多由素体阴虚蕴热，复感燥气疫毒时邪所致，治以养阴清肺，解毒利咽，故用养阴清肺汤（B对）。百合固金汤主治肺肾阴亏，虚火上炎证（A错）。养胃增液汤主治小儿厌食（C错）。麦味地黄丸主治肺肾阴虚证（D错）。知柏地黄丸主治肝肾阴虚，虚火上炎证（E错）。